伯氨喹可用于
A. 防止疟疾复发和传播
B. 病因性预防
C. 抑制蚊虫体内疟原虫的有性生殖
D. 继发性红细胞外期疟原虫及人体血液中各型疟原虫的配子体
E. 控制症状

正确答案：A、D。防止疟疾复发和传播；继发性红细胞外期疟原虫及人体血液中各型疟原虫的配子体

解析：本题考查伯氨喹。伯氨喹对良性疟继发性红外期的疟原虫有杀灭作用，用于控制良性疟的复发，与氯喹合用可根治良性疟。伯氨喹能杀灭人体血液中的各种疟原虫配子体，用于控制疟疾的传播（AD对）。乙胺嘧啶是用于病因性预防（B错）的首选药，能抑制蚊虫体内疟原虫的有性生殖（C错）。控制症状（E错）的抗疟药有氯喹、奎宁、青蒿素。